有一位女教师，下肢静脉曲张，术中可见静脉腔有多个褐色物，堵塞管腔，该褐色物最可能是下列哪种病变
A. 静脉内凝血
B. 静脉内血栓
C. 静脉内血栓栓子
D. 静脉内瘤栓
E. 静脉石

正确答案：B。静脉内血栓

解析：下肢静脉曲张患者的静脉壁薄弱且静脉瓣缺陷，导致静脉回流不畅，静脉血液流速减慢，容易形成静脉内血栓，故静脉腔内的褐色物最可能是静脉内血栓（B对）。静脉内凝血（A错）是生理性止血的重要环节，常发生于有轻微组织损伤的部位，其过程受多种因素的共同调解，故一般不会引起管腔堵塞。静脉内血栓栓子（P54）（C错）是指在循环血液中，随血液流动阻塞管腔的血栓，本例的褐色物是在下肢静脉内形成的血栓，不是随血流运行至此处的血栓栓子。本例患者无肿瘤病史，故褐色物不会是静脉内瘤栓（D错）。静脉石（E错）是指钙化后的静脉血栓，常见于病程较长的静脉曲张患者，较静脉血栓少见。